临床常需要治疗药物监测的药物是
A. 苯妥英钠
B. 阿司匹林
C. 万古霉素
D. 他克莫司
E. 甲氨蝶呤

正确答案：A、B、C、D、E。苯妥英钠；阿司匹林；万古霉素；他克莫司；甲氨蝶呤

解析：本题考查需要治疗药物监测的药物。常用药物的治疗监护有抗菌药物（C对），肾上腺皮质激素，非甾体抗炎药（B对），抗凝血药和抗血小板药，抗心力衰竭药，抗心律失常药（A对），抗癫痫药，免疫抑制药（D对），抗肿瘤药（E对）。